4岁时小儿的体重按公式粗略估计应为
A. 12kg
B. 13kg
C. 16kg
D. 18kg
E. 20kg

正确答案：C。16kg

解析：3～12月龄：体重（kg）=[年龄（月）+9]/2
1～6岁：体重（kg）=年龄（岁）×2+8
7～12岁：体重（kg）=[年龄（岁）×7-5]/2
12岁以后为青春发育阶段，受内分泌影响，体重增长较快（是体格增长的第二个高峰），且存在较大的个体差异，不再按上述公式计算。掌握“体格生长常用指标”知识点。